合理用药的概念是
A. 有效的
B. 最佳的
C. 缺一不可的
D. 相对的
E. 既经济又实用

正确答案：D。相对的

解析：本题考查的是合理用药的概念。合理用药的概念是相对的（D对）。所谓合理使用中药，是指运用中医药学综合知识及管理学知识指导临床用药。也就是以中医药理论为指导，在充分辨析疾病和掌握中药性能特点的基础上，安全、有效（A错）、简便、经济（E错）地使用中药或中成药，达到以最小的投入，取得最大的医疗和社会效益之目的。合理用药这一概念是相对的、动态发展的。一般认为，以某种中药或中成药治疗某种病证，在选用时认为其合理，仅是与同类药物相比较而言。其次，不同时期合理使用中药或中成药的标准也不同。这是因为随着中医药学及其他相关科学技术的发展，人类对疾病的病因病机和中药或中成药性能主治的认识也在不断地深化，以及新药的不断研制开发，必然会影响合理使用中药和中成药的标准，并促使其日臻科学完善。合理用药的目的，首先就是要最大限度地发挥药物治疗效能，将中药和中成药的不良反应降低到最低限度，甚至于零。其次是使患者用最少的支出，冒最小的风险，得到最好的治疗效果。其三是最有效地利用卫生资源，减少浪费，减轻患者的经济负担。其四是方便患者使用所选药物。合理用药是在充分考虑患者用药后获得的效益与承担的风险后作出的最佳（B错）选择。即使药效得到充分发挥，不良反应降至最低水平，药品费用更为合理。合理用药与广大群众的切身利益息息相关，是用药安全、有效、简便、经济的保障。合理用药可以经济有效地利用卫生资源，取得最大的医疗和社会效益，避免浪费。合理用药的基本原则就是安全、有效、简便、经济，四者缺一不可（C错）。